下列备洞原则中哪项是错误的
A. 尽可能去尽腐质
B. 尽可能保留健康的牙体组织
C. 所有的窝沟点隙均需做预防性扩展
D. 后牙邻面侧壁应扩展到接触区以外的自洁区
E. 外形线应建立在正常的牙体组织上

正确答案：C。所有的窝沟点隙均需做预防性扩展

解析：本题考查窝洞预备的基本原则。窝沟点隙可采用釉质成形术或窝沟封闭等处理代替预防性扩展，以保存更多的牙体组织（C错，为本题的正确答案）。尽可能去尽腐质，消除感染及刺激物，终止龋病发展，确保充填体与洞壁紧贴，防止继发龋发生（A对）。尽可能保留健康的牙体组织，以保证剩余牙体组织有足够抗力（B对）。后牙邻面侧壁应扩展到接触区以外的自洁区，便于清洁，防止继发龋（D对）。外形线应建立在正常的牙体组织上，以保证龋坏组织去净（E对）。